患者胸胁支满，心下痞闷，胃中有振水音，食后胃胀明显，经常呕吐清水痰涎，心悸头晕，形体逐渐消瘦，舌苔白滑，脉弦细而滑。其诊断是
A. 痰饮，脾阳虚弱
B. 悬饮，经气不和
C. 溢饮，寒饮内伏
D. 支饮，寒饮伏肺
E. 悬饮，饮停胸胁

正确答案：A。痰饮，脾阳虚弱

解析：患者以胸胁支满，心下痞闷，胃中有振水音为主诉，故诊断为痰饮；胃中停饮，支撑胸胁，故胸胁支满，心下痞闷，胃中有振水音；进食则胃纳增加，故食后胃胀明显；水饮上逆，故经常呕吐清水痰涎；饮凌心肺，故心悸头晕；脾虚不能化为精微充养形体，而致形体逐渐消瘦；舌苔白滑，脉弦细而滑为脾阳虚之征，故诊断为脾阳虚弱证（A对）。悬饮之经气不和证，其临床表现为胸胁疼痛，如灼如刺，胸闷不舒，呼吸不畅，或有闷咳，甚则迁延，经久不愈，阴雨更甚，可见病侧胸廓变形，舌苔薄，质黯，脉弦(B错)。溢饮没有寒饮内伏证（C错）。支饮之寒饮伏肺证，其临床表现为咳逆喘满不得卧，痰吐白沫量多，经久不愈，天冷受寒加重，甚至引起面浮跗肿。或平素伏而不作，遇寒即发，发则寒热，背痛，腰痛，目泣自出，身体振振困动。舌苔白滑或白腻，脉弦紧（D错）。悬饮之饮停胸胁证，其临床表现为胸胁疼痛，咳唾引痛，痛势较前减轻，而呼吸困难加重，咳逆气喘，息促不能平卧，仅能偏卧于停饮的一侧，病侧肋间胀满，甚则可见病侧胸廓隆起，舌苔白，脉沉弦或弦滑（E错）。